颏孔是哪个神经阻滞麻醉的部位
A. 鼻腭神经
B. 颊神经
C. 舌神经
D. 颏神经
E. 下牙槽神经

正确答案：D。颏神经

解析：颏孔为颏神经阻滞麻醉的部位。掌握“面部表面解剖”知识点。